不属于下颌骨内侧面的解剖结构是
A. 颏棘
B. 颏结节
C. 下颌小舌
D. 下颌下腺窝
E. 舌下腺窝

正确答案：B。颏结节

解析：下颌体：外侧面中线处有正中联合；正中联合两旁有左右各一的颏结节。所以颏结节不是下颌骨内侧面的结构。掌握“下颌骨及腭骨解剖特点”知识点。